胃热患者，其口气为
A. 酸臭
B. 奇臭
C. 臭秽
D. 腥臭
E. 腐臭

正确答案：C。臭秽

解析：胃火炽盛，胃中浊气上冲，则口气臭秽（C对）。口气酸臭，并伴食欲不振，脘腹胀满者，多属食积胃肠（A错）。口臭臭秽难闻，牙龈腐烂者，为牙疳（B错）。口气腥臭一般为内有痈脓（D错）。口气腐臭，或兼咳吐脓血者，多属内有溃腐脓疡（E错）。